紫癜风热伤络证的治法是
A. 清热解毒，凉血止血
B. 健脾养心，益气摄血
C. 滋阴降火，凉血止血
D. 清气凉营，解毒化瘀
E. 疏风散邪，清热凉血

正确答案：E。疏风散邪，清热凉血

解析：紫癜是小儿常见的出血性疾病之一，以血溢于皮肤、黏膜之下，出现瘀点瘀斑、压之不退色为其临床特征。风热伤络证由风热之邪外感，内窜血络所致，治则为疏风散邪，清热凉血（E对），清热解毒、凉血止血是血热妄行证的治则（A错）。健脾养心，益气摄血是气不摄血证的治则（B错）。滋阴降火，凉血止血是阴虚火旺证的治则（C错）。清气凉营，解毒化瘀不是紫癜的治则。